体现医患之间契约关系的有下列做法，但应除外
A. 患者挂号看病
B. 医生向患者作出应有承诺
C. 先收费用然后给予检查处置
D. 先签写手术协议书然后实施手术
E. 患者被迫送红包时保证不给医生宣扬

正确答案：E。患者被迫送红包时保证不给医生宣扬

解析：医疗契约又称医疗合同，是指平等主体的患者与医疗机构之间设立、变更、终止民事权利与义务关系的协议。被迫送红包不是医患之间的契约关系。掌握“医患关系伦理”知识点。